能够获得具有代表性和连续性的数据，反映我国整体污染状况的监测是
A. 常规监测
B. 专项监测
C. 应急监测
D. 主动监测
E. 被动监测

正确答案：A。常规监测

解析：本题考查常规监测。常规监测（A对BCDE错）主要是为获得具有代表性和连续性的数据，通过监测食用范围较广、食用量较大的食品，可反映出我国的整体污染状况、污染趋势并为食品安全风险评估、标准制（修）订提供代表性的监测数据，同时也可提示食品安全隐患。